下列哪种牙周可疑致病菌的存在与牙周炎在治疗后复发或病情继续加重有关
A. 中间普氏菌
B. 福赛类杆菌
C. 具核梭杆菌
D. 牙龈卟啉单胞菌
E. 伴放线放线杆菌

正确答案：D。牙龈卟啉单胞菌

解析：本题考查重要的牙周致病菌。牙龈卟啉单胞菌是慢性牙周炎病变区或活动部位最主要的优势菌（D对）。中间普氏菌是妊娠期龈炎的主要优势菌（A错）。福赛类杆菌常在重度牙周炎的附着丧失处的龈下菌斑中检出，吸烟者的检出率明显升高（B错）。具核梭杆菌是口腔坏疽性病变的主要病原菌，它能作用于甲硝唑，使其产生乙酰胺而失去抗菌作用，使伴随的牙龈卟啉单胞菌得到保护而生长（C错）。伴放线放线杆菌常见于侵袭性牙周炎的龈下菌斑中，是唯一能产生白细胞毒素的细菌（E错）。